有效成分能溶于水，且对湿、热较稳定的药材的提取宜采用
A. 浸渍法
B. 渗漉法
C. 水蒸气蒸馏法
D. 超临界流体提取法
E. 煎煮法

正确答案：E。煎煮法

解析：本题考查中药化学成分的提取方法。有效成分能溶于水，且对湿、热较稳定的药材的提取宜采用煎煮法（E对）。煎煮法：系指用水作溶剂，通过加热煮沸浸提药材成分的方法，又称煮提法或煎浸法。适用于有效成分能溶于水，且对湿、熟较稳定的药材。由于煎煮法能浸提出较多的成分，符合中医传统用药习惯，故对于有效成分尚不清楚的中药或方剂进行剂型改进时，通常采取煎煮法粗提。浸渍法（A错）：是在常温或温热（60℃-80℃）条件下用适当的溶剂浸渍药材以溶出其中有效成分的方法。本法适用于有效成分遇热不稳定的或含大量淀粉、树胶、果胶、黏液质的中药的提取。但本法出膏率低，需要特别注意的是当水为溶剂时，其提取液易于发霉变质，需注意加入适当的防腐剂。渗漉法（B错）：渗漉法属于动态浸提，即溶剂相对药粉流动浸提，溶剂的利用率高，有效成分浸出完全。故适用于贵重药材、毒性药材及高浓度制剂；也可用于有效成分含量较低的药材的浸提。但对新鲜的及易膨胀的药材、无组织结构的药材则不宜选用。水蒸气蒸馏法（C错）：适用于具有挥发性的、能随水蒸气蒸馏而不被破坏，且难溶或不溶于水的化学成分的提取。此类化合物的沸点多在100℃以上，并在100℃左右有一定的蒸气压。超临界流体提取法（D错）：与传统浸提方法如煎煮法、水蒸气蒸馏法相比，超临界CO₂，萃取法既可避免高温破坏，又无溶剂残留，且将萃取和分离合二为一，可节能降耗。超临界流体萃取适用于亲脂性、分子量小的物质的萃取；对于分子量大、极性强的物质萃取时需加改性剂及提高萃取压力。